子宫肌瘤发生红色样变常见于
A. 妊娠期
B. 月经中期
C. 绝经前期
D. 红斑狼疮治疗期
E. 生育期

正确答案：A。妊娠期

解析：子宫肌瘤发生红色样变常见于妊娠期（A对）或产褥期，其发生机制不清，可能与肌瘤内小血管退行性变使血栓、血红蛋白渗入肌瘤内有关。